男，42岁。右上腹突发剧烈疼痛2小时，伴呕吐、尿黄。发病前3小时饮白酒约300ml，并进食较多油腻食物。查体：右上腹有压痛及反跳痛。最有诊断价值的检查是
A. 尿淀粉酶
B. 腹部B超
C. 胃镜
D. 血淀粉酶
E. 腹部X线平片

正确答案：B。腹部B超

解析：青年男性患者，高脂饮食后突发上腹痛、尿黄，右上腹压痛及反跳痛，需考虑急性结石性胆囊炎。此时，最有价值的检查是腹部B超（B对），可见胆囊增大、囊壁增厚（＞4mm）、强回声的胆囊结石，亦可观察是否合并胆管结石。尿淀粉酶（A错）、血淀粉酶（D错）主要用于辅助诊断急性胰腺炎。胃镜（C错）主要用于上消化道病变的诊断，无法发现胰腺的病变。腹部X线平片（E错）可发现部分含钙量高的结石，对明确诊断有一定帮助，但诊断价值不如腹部B超。